表面淡黄白色，粗糙，质坚而脆，断面皮部浅黄白色，木部黄色，气特异的中药材是
A. 葛根
B. 柴胡
C. 赤芍
D. 南沙参
E. 北沙参

正确答案：E。北沙参

解析：本题考查的是北沙参药材的性状鉴别。表面淡黄白色，粗糙，质坚而脆，断面皮部浅黄白色，木部黄色，气特异的中药材是北沙参（E对）。北沙参：【性状鉴别】药材呈细长圆柱形，偶有分枝。表面淡黄白色，略粗糙，偶有残存外皮。不去外皮的表面黄棕色，全体有细纵皱纹及纵沟，并有棕黄色点状细根痕；顶端常留有黄棕色根茎残基；上端稍细，中部略粗，下部渐细。质脆，易折断，断面皮部浅黄白色，木部黄色。气特异，味微甘。葛根（A错）：【性状鉴别】药材呈纵切的长方形厚片或小方块。外皮淡棕色至棕色，有纵皱纹，粗糙。切面黄白色至淡黄棕色，有的纹理不明显。质韧，纤维性强。气微，味微甜。柴胡（B错）：【性状鉴别】药材北柴胡呈圆柱形或长圆锥形，根头膨大，顶端有3～15个残留的茎基或短纤维状的叶基，下部分枝。表面黑褐色或浅棕色，具纵皱纹，支根痕及皮孔。质硬而韧，不易折断，断面呈片状纤维性，皮部浅棕色，木部黄白色。气微香，味微苦。赤芍（C错）：【性状鉴别】药材呈圆柱形，稍弯曲。表面棕褐色，粗糙，有纵沟及皱纹，并有须根痕及横长的皮孔样突起，有的外皮易脱落。质硬而脆，易折断，断面粉白色或粉红色，皮部窄，木部放射状纹理明显，有的有裂隙。气微香，味微苦、酸涩。南沙参（D错）：【性状鉴别】药材呈圆锥形或圆柱形，略弯曲。表面黄白色或淡棕黄色，凹陷处常有残留粗皮，上部多有深陷横纹，呈断续的环纹，下部有纵纹及纵沟。顶端具1或2个根茎。体轻，质松泡，易折断，断面不平坦，黄白色，多裂隙。气微，味微甘。